由于水体中大量氮、磷元素等营养物质增多，藻类等浮游生物大量繁殖，这种现象发生在内陆湖泊中称为
A. 赤潮
B. 水华
C. 富营养化
D. 腐殖质化
E. 氧化塘形成

正确答案：B。水华

解析：本题考查水华。由于水体中大量氮、磷元素等营养物质增多，藻类等浮游生物大量繁殖，这种现象发生在内陆湖泊中称为水华（B对ACDE错）。水华现象发生时，湖水的色泽会发生变化，由正常的碧绿色变成浅绿色、灰绿色或乳白色，水体表面会出现一层浮游植物的污泥膜。水华不仅会影响湖泊的外观，还会影响周边环境的水质，进而影响水中生物的生存环境。水华会使水体的溶解氧减少，淤泥颗粒悬浮在水中，会影响鱼类的繁殖，还会使水中的酸碱度、水温、pH值等发生变化，影响水体中生物的迁徙，对水体的原始生态系统和环境造成很大的破坏。